一类精神药品
A. 只能在医疗单位配方使用
B. 只能在医药商店零售
C. 在省级新特药商店配方、销售
D. 由医药商店凭盖有医疗单位公章的医生处方配方
E. 在百货商厦、超市等销售

正确答案：A。只能在医疗单位配方使用

解析：本题考查一类精神药品。被列于27种毒性中药材品种的是。一类精神药品只能在医疗单位配方使用（A对）。麻醉药品和第一类精神药品不得零售，只能在医疗单位配方使用。除经批准的药品零售连锁企业外，其他药品零售企业不得从事第二类精神药品零售活动。